硝酸甘油的临床应用有
A. 劳累性心绞痛
B. 自发性心绞痛
C. 低血压
D. 充血性心力衰竭
E. 急性心肌梗死

正确答案：A、B、D、E。劳累性心绞痛；自发性心绞痛；充血性心力衰竭；急性心肌梗死

解析：本题考查硝酸甘油。硝酸甘油的临床应用有：劳累性心绞痛（A对）、自发性心绞痛（B对）、充血性心力衰竭（D对）、急性心肌梗死（E对）。硝酸甘油主要用于治疗和预防各种类型心绞痛，也用于充血性心力衰竭及急性心肌梗死。硝酸甘油是通过松弛平滑肌扩张血管起作用，能够降低血压，不能对抗低血压（C错）。